妊娠合并慢性肾炎脾虚湿盛证治疗方剂为
A. 白术散
B. 防己黄芪汤
C. 生脉散
D. 真武汤
E. 猪苓汤

正确答案：A。白术散

解析：妊娠合并慢性肾炎脾虚湿盛证因孕母素体脾虚，运化失职，肾气不能化气行水，水湿停聚，痰浊内生所致。治宜燥湿和胃，温肾健脾，方用健脾养胎，温中燥湿的白术散（A对）。防己黄芪汤（B错）主治表虚风水或水湿；猪苓汤（E错）主治水热互结伤阴证；真武汤（D错）功效为温阳利水，主治妊娠合并慢性肾炎肾阳虚证；生脉散（C错）功用益气生津，敛阴止汗。